室间隔缺损血流动力学改变首先引起
A. 右心室增大
B. 左心室增大
C. 左心房增大
D. 主动脉扩张
E. 肺动脉扩张

正确答案：B。左心室增大

解析：室间隔缺损血流动力学改变首先引起左心室增大（B对），虽然室间隔缺损时是左向右分流，但由于心脏几乎是处于同步收缩，此时右室的血流直接射入肺动脉，血液在右心室停留时间较短，因此，较难引起右心室肥大，后期病情严重，引起肺动脉高压，此时容易引起右心室肥大。